雌激素的生理作用，下列哪项是正确的
A. 可增加子宫平滑肌对缩宫素的敏感性
B. 可降低妊娠子宫对缩宫的敏感性
C. 使增生期的子宫内膜转化为分泌期内膜
D. 使阴道上皮细胞脱落加快
E. 影响脑垂体促性腺激素的分泌

正确答案：A。可增加子宫平滑肌对缩宫素的敏感性

解析：雌激素的生理作用促进子宫肌细胞增生和肥大，使肌层增厚；增进血运，促使和维持子宫发育；增加子宫平滑肌对缩宫素的敏感性。掌握“女性生殖系统生理”知识点。